婴儿期至少要进行几次健康检查
A. 1
B. 2
C. 3
D. 4
E. 5

正确答案：D。4

解析：本题考查婴儿期健康检查的相关内容。婴儿期的健康检查至少4次（D对CE错），建议分别在3、6、8和12月龄；3岁及以下儿童每年至少2次（B错），每次间隔6个月，时间在1岁半、2岁、2岁半和3岁；3岁以上儿童每年至少1次（A错）。